关于经典毒物动力学说法错误的是
A. 经典动力学基本理论是速率论和房室模型
B. 房室模型可分为一室开发模型、二室开放模型、多室模型
C. 化学毒物转运的速率过程分为一级、零级和非线性3种类型
D. 毒物动力学参数AUC越大，药物消除速率越快

正确答案：D。毒物动力学参数AUC越大，药物消除速率越快

解析：本题考查经典毒物动力学的相关内容。经典毒物动力学有速率类型和室模型两个基本概念对（A对）。化学毒物转运的速率过程分为一级、零级和非线性3种类型（C对）。房室模型可分为一室开发模型、二室开放模型、多室模型（B对）。毒物动力学参数AUC越大，药物消除速率越慢（D错，为本题正确答案）。